普鲁卡因的特点中哪项是错误的
A. 麻醉持续时间较长
B. 毒性和毒作用小
C. 偶尔发生过敏反应
D. 表面渗透性最强
E. 一次最大用量1g

正确答案：D。表面渗透性最强

解析：本题考查普鲁卡因的特点。普鲁卡因属于短效酯类局麻药，脂溶性蛋白结合率和麻醉强度均较低低，作用时效短，弥散能力差，不能穿透皮肤和黏膜（D错，为本题的正确答案）。普鲁卡因麻醉时间可持续30～60分钟，加入肾上腺素可延长20%以上（A对）。普鲁卡因的毒性低，毒素作用小（B对）。普鲁卡因个别患者有过敏反应（C对）发生，轻者全身发痒和寒战，皮肤出现荨麻疹，严重者会出现哮喘样呼吸困难并休克等。普鲁卡因成人一次最大剂量为1g（E对）。